松果体的描述，错误的是
A. 位于上丘脑的后上方
B. 为一椭圆形小体
C. 形似松果、色灰红
D. 伸入延髓小脑池
E. 成年后有钙盐沉积密度较高，在X片上可见，临床上称“脑砂”

正确答案：D。伸入延髓小脑池

解析：松果体为一形似松果、色灰红（C对）的椭圆形腺体（B对）, 重120 -200mg。位于上丘脑的后上方（A对），以柄附着于第三脑室顶的后部。松果体在儿童期比较发达，一般在7岁左右开始退化，青春期后松果体可有钙盐沉积密度较高，在X片上可见，临床上称“脑砂”（E对）。松果体表面包以软脑膜，结缔组织伴随血管伸人腺实质内，将实质分为许多小叶。脑室系统内的脑脊液经单一的第四脑室正中孔 ，成对的第四脑室外侧孔 3个孔注入蛛网膜下隙的小脑延髓池。松果体位于小脑延髓池上方，未伸入其中（D错，为本题正确答案）。